治疗三叉神经痛的中成药是
A. 氯硝西泮
B. 苯妥英钠
C. 卡马西平
D. 山莨菪碱
E. 七叶莲

正确答案：E。七叶莲

解析：七叶莲：是中成药，用于治疗三叉神经痛，每次3片（每片含量相当于生药5g），4次/天。掌握“三叉神经痛”知识点。